下列哪种不是MHC作为抗原提呈分子参与适应性免疫应答的
A. T细胞以TCR实现对抗原肽和MHC分子的双重识别
B. 被MHC分子结合并提呈的成分
C. MHC是疾病易感性个体差异的主要决定者
D. 炎症相关基因参与启动和调控炎症反应
E. MHC参与构成种群基因结构的异致性

正确答案：D。炎症相关基因参与启动和调控炎症反应

解析：MHC作为抗原提呈分子参与适应性免疫应答的有：①T细胞以TCR实现对抗原肽和MHC分子的双重识别；②被MHC分子结合并提呈的成分；③MHC是疾病易感性个体差异的主要决定者④MHC参与构成种群基因结构的异致性；炎症相关基因参与启动和调控炎症反应属于作为调节分子参与固有免疫应答。掌握“HLA种类及其产物、医学意义”知识点。